六淫邪气中，易伤津耗气的是
A. 暑邪
B. 湿邪
C. 寒邪
D. 燥邪
E. 风邪

正确答案：A。暑邪

解析：暑为阳邪，其致病具有炎热、升散的特性，能扰神伤津耗气，多挟湿邪。《素问·举痛论》说：“炅则气泄”汗出过多，不仅伤津，而且耗气，故临床除口渴喜饮、尿赤短少等津液不足之症状外，常见气短乏力，甚则气津耗伤太过，清窍失养而突然昏倒，不省人事（A对）。